观察期内带病入家的某身份成员数占其同等身份成员数的比例为
A. 引入率
B. 续发率
C. 发病率
D. 病死率
E. 累积死亡率

正确答案：A。引入率